下述氨基酸中属于人体必需氨基酸的是
A. 甘氨酸
B. 组氨酸
C. 苏氨酸
D. 脯氨酸
E. 丝氨酸

正确答案：C。苏氨酸

解析：据最新九版教材人体必需氨基酸包括亮氨酸、异亮氨酸、苏氨酸（C对）、缬氨酸、赖氨酸、甲硫氨酸、苯丙氨酸和色氨酸和组氨酸（B对），原答案选C，现BC均对。